经常汗出不止，活动后加重是
A. 盗汗
B. 自汗
C. 战汗
D. 大汗
E. 绝汗

正确答案：B。自汗

解析：本题考查的是自汗的临床表现。经常汗出不止，活动后加重是自汗（B对）。问汗出的临床意义：汗为心液，是阳气蒸化津液，出于体表而成，即所谓“阳加于阴谓之汗”。出汗的病变，在外感证和内伤证中都可以见到。询问出汗的情况，首先要问有汗或无汗，然后再进一步问清出汗的时间、出汗的部位，汗量的多少及其主要兼证等。兹将常见汗出辨析分述如下。1.表证辨汗的临床意义：表证是病位在肌表，了解表证有汗与无汗，往往可以分辨感受外邪的性质和正气的盛衰。表证无汗，多属外感寒邪。表证有汗，多属外感风邪。因此，外感风热，以及卫阳虚弱、复感风热外邪的表证，都可以见到出汗。2.自汗临床表现及意义：自汗，指经常汗出不止，活动后加重的临床表现。3.盗汗（A错）临床表现及意义：盗汗，指入睡则汗出，醒后则汗止的临床表现。4.绝汗（E错）临床表现及意义：绝汗，指病情危重之时，大汗（D错）不止的临床表现。5.战汗（C错）临床表现及意义：战汗，指先见全身恶寒战栗，而继之汗出的临床表现。